重组人粒细胞集落刺激因子（rhG⁻CSF）可用于
A. 缺铁性贫血
B. 化疗后白细胞下降
C. 再生障碍性贫血
D. 血小板减少
E. 巨幼红细胞性贫血

正确答案：B、C。化疗后白细胞下降；再生障碍性贫血

解析：本题考查重组人体粒细胞集落刺激因子。重组人粒细胞集落刺激因子（rhG⁻CSF）可用于化疗后白细胞下降（B对）、再生障碍性贫血（C对）。重组人粒细胞集落刺激因子可有效治疗粒细胞减少引起的一系列疾病，能够使粒细胞数目回升，主要用于肿瘤、再生障碍性贫血、骨髓发育不良等疾病。缺铁性贫血（A错）临床主要以铁剂治疗。巨幼红细胞性贫血（E错）主要用叶酸和维生素B₁₂治疗。凝血障碍（D错）临床可用促凝血药辅助治疗。